肝病日久，两胁胀满疼痛，并见舌质瘀斑、瘀点。其病机是
A. 气血两虚
B. 气血失和
C. 气不摄血
D. 气随血脱
E. 气滞血瘀

正确答案：E。气滞血瘀

解析：肝主疏泄，肝病日久，气机郁滞不畅，故两胁胀满疼痛；气滞血行不畅，故见舌质瘀斑、瘀点，故其病机为气滞血瘀（E对）。气血两虚（A错）证指兼有气虚和血虚的证候，其证候表现为神疲乏力，少气懒言，自汗，面色淡白，头晕目眩，心悸失眠，形体消瘦，月经量少色淡，舌质淡白，脉细无力。气血失和（B错）证，即气虚血瘀证，指兼有气虚和血瘀的证候，其证候表现为面色淡白或面色暗滞，倦怠乏力，少气懒言，胸胁或其他部位疼痛如刺，痛处固定不移、拒按，舌淡暗或有紫斑、紫点，脉涩。气不摄血（C错）证指慢性出血与气虚的证候同见，其证候表现为鼻衄、齿衄、崩漏等各种出血，面色淡白无华，神疲乏力，少气懒言，心悸失眠，舌淡白，脉弱。气随血脱（D错）证指大量出血与阳气虚衰的证候同见，其证候表现为大量出血时，突然面色苍白，气少息微，大汗淋漓，手足厥冷，甚至晕厥，或舌淡，脉微或芤或散。